以下除哪项外，均为桂枝汤证可见之脉症
A. 脉浮数
B. 脉浮弱
C. 身体疼痛
D. 项背强
E. 鼻鸣干呕

正确答案：C。身体疼痛

解析：阳浮而阴弱，既指脉象之浮缓，又述病机之卫强营弱。风寒袭表，卫阳浮盛，故脉轻取显浮；由于汗出，营阴外泄，故脉沉取显弱。阳浮阴弱即脉浮缓之互称，是中风证的典型脉象（BE对）。太阳伤寒发汗后，余邪未尽，仍宜汗解的治法。太阳伤寒用麻黄汤发汗后，若脉静身和，为邪已解，病证向愈。但经过半天左右，病人又见复烦，即发热、恶风寒、脉浮数等症相继出现，为余邪在表未尽，治疗可再用发汗之法，故曰可更发汗。然由于患者前已使用发汗，不堪峻汗，故只宜桂枝汤解肌祛风，调和营卫（A对）。太阳病兼项背强几几者多表现为无汗恶风，本证有汗出，故曰“反”。综合本证病机，当为风寒外束，营卫不和，经气不利，筋脉失养。故治当解肌祛风，调和营卫，升津舒经，方以桂枝加葛根汤（D对）（C错，为本题正确答案）。